剥脱性龈病损不包括
A. 牙龈红斑
B. 牙龈红斑狼疮
C. 牙龈类天疱疮
D. 牙龈天疱疮
E. 牙龈扁平苔藓

正确答案：A。牙龈红斑

解析：剥脱性龈病损的特征是牙龈鲜红、光亮，或表面脱皮，形成粗糙的糜烂面。由于上皮层的剥脱而形成无上皮的表面。Prinz（1932）首先使用慢性弥漫性剥脱性龈炎的名称，但近来众多的研究证明，所谓的剥脱性龈炎不是或大多数不是一种独立的疾病，而是许多疾病在牙龈上的表征，其中包括：类天疱疮、扁平苔藓、天疱疮、红斑狼疮等。真正的或称为特发性剥脱性龈炎者为数甚少，仅指那些不能诊断为其他疾病的剥脱性龈病损而言。掌握“牙龈疾病”知识点。